两样本均数比较的假设检验可考虑用
A. F统计量
B. t统计量
C. A、B均可
D. χ²统计量
E. 秩和检验

正确答案：C。A、B均可